有关内侧丘系的描述，正确的是
A. 纤维束起自同侧薄束核和楔束核
B. 在脑桥穿过斜方体内
C. 终于丘脑腹后外侧核
D. 在延髓行经顶盖脊髓束腹侧
E. 传导本体觉和粗触觉

正确答案：C。终于丘脑腹后外侧核

解析：内侧丘系参与躯干和四肢意识性本体感觉的精细触觉传导通路（E错）。纤维束起自对侧薄束核和楔束核（A错）。薄、楔束核发出的纤维向前绕过中央灰质的腹侧，在中线上与对侧的交叉，称内侧丘系交叉（B错），交叉后的纤维转折向上，形成内侧丘系，最后止于背侧丘脑腹后外侧核（C对）。